血清淀粉酶水平是临床上诊断和监测急性胰腺炎的重要指标，其升高的高峰一般出现在发病后
A. 4小时
B. 48小时
C. 12小时
D. 24小时
E. 8小时

正确答案：D。24小时

解析：尿淀粉酶在24小时后才开始升高，48小时到高峰，下降缓慢，一到两周后恢复正常（B错）（P459），血清淀粉酶在发病数小时开始升高，24小时达高峰，4~5天后逐渐降至正常（D对）。在急性胰腺炎的实验室检验中，血清淀粉酶的峰值是提前于尿淀粉酶的，我们可以记忆为，由尿排出的物质首先是存在于血液中的，之后才经过肾小球滤过排出。实际情况可能不是这样的，但是我们可以这样记忆。